地方性氟病发病明显增加一般在
A. 6岁以后
B. 16岁以后
C. 26岁以后
D. 36岁以后
E. 46岁以后

正确答案：B。16岁以后

解析：本题考查地方性氟病发病明显增加的年龄。地方性氟病是由于一定地区的环境中氟元素过多，而致生活在该环境中的居民经饮水、食物和空气等途径长期摄入过量氟所引起的以氟骨症和氟斑牙为主要特征的一种慢性全身性疾病。该病一般在16岁以后（B对ACDE错）发病明显增加。